男，45岁。1天前进食较硬食物后突发呕血1次，约400ml，排黑色糊状便2次，每次量约200g，无腹痛。既往乙型肝炎病史14年，1年前发生类似呕血1次。查体：BP105/65mmHg。皮肤巩膜无黄染，腹软，无压痛，肝肋下未触及，脾肋下2cm，移动性浊音阴性，肠鸣音4～5次/分。实验室检查：Hb95g/L，WBC2.5×10⁹/L，plt47×10⁹/L。目前最有意义的检查方法是
A. 胃镜
B. 腹部CT
C. 腹部B超
D. 腹部MRI
E. 上消化道X线钡剂造影

正确答案：A。胃镜

解析：中年男性患者，既往乙型肝炎病史14年（肝硬化的高危因素），1天前进食较硬食物后（食管胃底静脉曲张出血的常见诱因）突发呕血1次，约400ml，排黑色糊状便2次，每次约200g（上消化道出血的表现）。查体：脾肋下2cm（脾肿大）。实验室检查：Hb95g/L（正常值为120～160g/L，提示有贫血），WBC2.5×10⁹ （正常值为4～10×10⁹/L，提示白细胞减少），plt47×10⁹ （正常值为100～300×10⁹/L，提示血小板减少），考虑为脾肿大、脾功能亢进所致。综合患者的病史、临床表现、查体和实验室检查，可初步诊断为肝炎后肝硬化伴食管胃底静脉曲张破裂。胃镜（A对）有助于明确出血的部位和性质，并可同时进行止血，为目前最有意义的检查方法。腹部CT（B错）、腹部B超（C错）、腹部MRI（D错）可用来证实脾大、肝脏形态变化，但不能明确肝硬化上消化道出血的具体病因。上消化道X线钡剂造影（E错）不能用于上消化道急性出血期。